根据《疫苗流通和预防接种管理条例》，不得从事疫苗经营活动的是
A. 定点药品零售企业
B. 疫苗药品批发企业
C. 县级疾病预防控制机构
D. 设区的市级以上疾病预防控制机构
E. 国家疾病预防控制机构

正确答案：A。定点药品零售企业